男孩，1岁。发热8天，皮疹3天入院。外院抗生素治疗7天无效。查体：T39℃，烦躁不安，全身淡红色斑丘疹，双眼结膜充血，口唇鲜红、干裂、草莓舌，右颈淋巴结蚕豆大，质硬，有压痛。双肺呼吸音粗，心率130次/分，腹软，肝、脾无肿大，指、趾端硬性肿胀。实验室检查：血WBC19×10⁹/L，N0.78，L0.22，Plt420×10⁹/L，血沉120mm/h，血培养（-）。对预后有重要意义的随访检查项目是
A. ASO、ESR
B. 血常规
C. 心脏彩超
D. 心电图
E. 尿常规

正确答案：C。心脏彩超

解析：对川崎病患儿而言，多发性冠状动脉瘤是决定该病预后最重要的因素，因此要随访时最重要的是观察患儿冠状动脉病变的程度，选项中只有心脏彩超能了解到冠脉的情况（C对），ASO、ESR（A错）、血常规（B错）、心电图（D错）、尿常规（E错）都是一般的随访项目。